视网膜中央动脉来源于
A. 面动脉
B. 内眦动脉
C. 颈内动脉
D. 眼动脉
E. 椎动脉

正确答案：D。眼动脉

解析：视网膜中央动脉来源于眼动脉（D对）。